与髓室顶相对的髓室壁称
A. 髓室顶
B. 髓室底
C. 髓室高度
D. 根管口
E. 髓角

正确答案：B。髓室底

解析：与髓室顶相对的髓室壁称髓室底。掌握“髓腔各部分名称、增龄性变化及临床意义”知识点。